具有稳定和支持义齿的作用，可防止义齿侧向和龈向移动
A. 基托
B. 卡环臂
C. 单个支托
D. 卡环体
E. （牙合）支托

正确答案：D。卡环体

解析：卡环体：为连接卡环臂、（牙合）支托及小连接体的坚硬部分，位于基牙轴面角的非倒凹区，有稳定和支持义齿的作用，可防止义齿侧向和龈向移动。掌握“局部义齿人工牙及基托”知识点。